属于社区卫生服务特点的是
A. 以健康为中心
B. 以患者为中心
C. 以疾病为中心
D. 以家属为中心
E. 以上均正确

正确答案：A。以健康为中心

解析：社区卫生服务其特点包括：以健康为中心，社区卫生服务必须以人为本，以人的健康为中心，而不是以患者为中心，更不是以疾病为中心。掌握“社区口腔卫生服务”知识点。